医德评价的意义应除外
A. 医务人员满足自我心理需求的手段
B. 医务人员行为的监视器和调节器
C. 维护医德原则的重要保障
D. 维护医德规范的重要保障
E. 使医德原则、规范转化为医德行为的中介和桥梁

正确答案：A。医务人员满足自我心理需求的手段

解析：医德评价是人们依据一定的医德标准和原则，对医务人员或医院的医德行为作出好坏是非判断的活动。医务人员是医德评价的对象，故不选A。掌握“医学道德评价”知识点。